不影响患者遵医行为的因素是
A. 病人的经济状况
B. 病人的人口统计学特点
C. 医患关系
D. 疾病严重程度
E. 治疗计划特点

正确答案：A。病人的经济状况